2%醋酸浸渍，不能溶解的生物碱是
A. 秋水仙碱
B. 小檗碱
C. 氧化苦参碱
D. 吗啡
E. 麻黄碱

正确答案：A。秋水仙碱

解析：本题考查的是生物碱的性质。2%醋酸浸渍，不能溶解的生物碱是秋水仙碱（A对）。酰胺类生物碱：由于酰胺在水中可形成氢键，所以在水中有一定的溶解度，如秋水仙碱、咖啡碱。秋水仙碱碱性较弱，不能溶于2%醋酸。提取氧化苦参碱（C错）可将醋酸水溶液用NaOH碱化至pH为9，氯仿萃取，溶于氯仿；NaOH碱水加HCl调至pH为2-3，加饱和NaCl溶液放置，沉淀的是小檗碱（B错）。水蒸气蒸馏法用于提取能随水蒸气蒸馏而不被破坏的难溶于水的成分。这类成分有挥发性，可随水蒸气逸出，冷凝后可用油水分离器或有机溶剂萃取法将该类成分自馏出液中分离。中药挥发油及某些具挥发性的小分子生物碱、小分子酚性物质等均可应用本法提取。少数液体生物碱及小分子固体生物碱如麻黄碱（E错）、烟碱等具挥发性。